氮氧化物中毒的急性临床表现主要是
A. 刺激呼吸道深部，引起咳嗽、咳痰
B. 致肺水肿
C. 引起上呼吸道炎症及肺炎
D. 迷走神经反射性心脏骤停
E. 意识摩碍

正确答案：B。致肺水肿